达到杀酶保苷和软化药物的目的，既可采用蒸法又可采用沸水煮法炮制的药材是
A. 人参
B. 地黄
C. 川乌
D. 黄芩
E. 远志

正确答案：D。黄芩

解析：本题考查的是黄芩的炮制作用。达到杀酶保苷和软化药物的目的，既可采用蒸法又可采用沸水煮法炮制的药材是黄芩（D对）。黄芩蒸或沸水煮的目的是灭活酶，防止苷类成分分解，以保存药效，又能使药物软化，便于切片。人参（A错）【炮制作用】人参性味甘、微苦，微温。归脾、肺、心、肾经。具有大补元气、复脉固脱、补脾益肺、生津养血、安神益智的功能。地黄（B错）【炮制作用】鲜地黄味甘、苦，性寒。归心、肝、肾经。具有清热生津、凉血、止血的功能。用于热病伤阴，舌绛烦渴，温毒发斑，吐血衄血，咽喉肿痛等。川乌（C错）【炮制作用】川乌味辛、苦，性热；有大毒。归心、肝、脾、肾经。具有祛风除湿、温经止痛的功能。远志（E错）【炮制作用】远志味苦、辛，性温。归心、肾、肺经。具有安神益智，交通心肾，祛痰，消肿的功效。